临床上不需要进行治疗药物监测（TDM）的药品是
A. 地高辛
B. 阿司匹林
C. 环孢素
D. 甲氨蝶呤
E. 万古霉素

正确答案：B。阿司匹林

解析：本题考查治疗药物监测。治疗药物监测（TDM）是指在药代动力学原理的指导下，应用现代化分析技术，测定血液中或其他体液中药物浓度，用于药物治疗的指导与评价。阿司匹林（B对）不需要进行治疗药物监测。地高辛治疗剂量与中毒剂量接近，应进行TDM。环孢素常见不良反应有肾毒性、肝毒性、神经毒性等，应进行TDM。甲氨蝶呤常见不良反应有骨髓抑制、肝毒性、胃肠道反应等，应进行TDM。万古霉素常见不良反应有耳毒性、肾损害，应进行TDM。